26岁，女性，停经45天，突感下腹坠痛及肛门坠胀感，少量阴道流血及头晕呕吐半天。体格检查：面色苍白，BP80／40mmHg，腹肌略紧张，下腹压痛。妇科检查：阴道少量血性物，宫颈举痛（+），后穹隆饱满，子宫稍大，附件区触诊不满意，本例最恰当的处理是
A. 中医治疗
B. 纠正休克
C. 输血同时手术探查
D. 应用抗生素
E. 静脉输液

正确答案：C。输血同时手术探查

解析：青年女性，停经45天，突感下腹坠痛及肛门坠胀感，少量阴道流血及头晕呕吐半天（异位妊娠的典型症状为停经后腹痛与阴道流血）。体格检查：面色苍白，BP80/40mmHg（当腹腔出血较多时，可出现面色苍白、脉搏快而细弱、心率增快和血压下降等休克表现），腹肌略紧张，下腹压痛（腹部检查：下腹有明显压痛及反跳痛，尤以患侧为著，但腹肌紧张轻微）。妇科检查：阴道少量血性物，宫颈举痛（+），后穹隆饱满（输卵管妊娠流产或破裂者，阴道后穹窿饱满，有触痛。将宫颈轻轻上抬或向左右摆动时引起剧烈疼痛，称为宫颈举痛或摇摆痛），综合以上症状和检查体征，应诊断为异位妊娠破裂。异位妊娠破裂内出血并发休克时最恰当的处理是输血同时手术探查（C对），即在积极抗休克的同时迅速打开腹腔，钳夹输卵管出血部位，暂时控制出血，待血压上升后继续手术切除患侧输卵管。单纯纠正休克（B错）或静脉输液（E错），不能阻止内出血。中医治疗（A错）为辅助性治疗措施。应用抗生素（D错）对治疗异位妊娠破裂出血引起的休克没有帮助。